中毒型细菌性痢疾的内因是
A. 脾胃虚弱，伏痰停留
B. 肾气亏虚，开合失司
C. 脾胃薄弱，卫外不固
D. 时邪疫毒，经口入腹
E. 肺气亏虚，营卫失调

正确答案：C。脾胃薄弱，卫外不固

解析：中毒型细菌性痢疾的外因是感染有疫毒的不洁之物，从口入腹，蕴伏肠胃，”邪气所在，其气必虚“，夏秋之季，湿热内盛，脾胃受困，加之小儿肠胃脆弱，秽邪毒疫最易入侵，故脾胃薄弱，卫外不固是本病的内因（C对）。时邪疫毒，经口入腹（D错）为中毒型细菌性痢疾的外因。